对慢性非传染性疾病的防治，最根本的措施是
A. 加强基础科学的研究
B. 深化对健康和疾病的认识
C. 改善康复治疗条件，提高康复水平
D. 动员全社会参与，防患于未然
E. 加强临床监测技术，引进先进治疗手段

正确答案：D。动员全社会参与，防患于未然